若妇人肾阴不足或真阴亏损致经、带、胎、产诸疾，其治法是
A. 滋阴潜阳
B. 温肾助阳
C. 益火之源，以消阴翳
D. 壮水之主，以制阳光
E. 滋养肾阴，填精益髓

正确答案：E。滋养肾阴，填精益髓

解析：肾阴不足则“滋养肾阴”，真阴亏损则“填精益髓”（E对）。滋阴潜阳（A错）适用于阴虚阳亢证；温肾助阳（B错）适用于肾阳亏虚证；“益火之源，以消阴翳”（C错）即扶阳益火，以消退阴盛，为阴病治阳；“壮水之主，以制阳光”（D错）即滋阴壮水，以抑制阳亢火盛，为阳病治阴。